第二类病原微生物是指
A. 能够引起人类或者动物非常严重疾病的微生物
B. 我国尚未发现或者已经宣布消灭的微生物
C. 能够引起人类或者动物严重疾病，比较容易直接或者间接在人与人、动物与人、动物与动物间传播的微生物
D. 具备有效治疗和预防措施的微生物
E. 通常情况下不会引起人类或者动物疾病的微生物

正确答案：C。能够引起人类或者动物严重疾病，比较容易直接或者间接在人与人、动物与人、动物与动物间传播的微生物